患者，男，40岁，喉结两侧各有1个3cm×2cm×1cm,表面光滑，质地韧，无压痛，随吞咽上下活动的肿物。为明确诊断，应首选的检查方法是
A. 胸颈部X线
B. 血常规
C. 血气分析
D. T3、T4
E. 碘131扫描

正确答案：E。碘131扫描

解析：该患者符合肉瘿的临床表现：在结喉正中一侧或双侧有单个肿块，呈半圆形，表面光滑，可随吞咽动作上下移动，按之不通，当用同位素131碘扫描与石瘿鉴别，前者为温结节，后者多为冷结节，结合临床症状可区分（E对）。胸颈部X线常用于检查骨性疾病及肺系疾病（A错）。血常规常用于感染性疾病及血液系统的疾病（B错）。血气分析是通过测定人体血液的pH和溶解在血液中的气体（主要指CO2、O2），来了解人体呼吸功能与酸碱平衡状态的一种手段（C错）。T3、T4是诊断诊断甲状腺功能的主要指标（D错）。